三氧化二砷与细胞内哪种抗氧化分子结合，从而诱导细胞凋亡
A. 谷胱甘肽（GSH）
B. 一氧化氮合酶
C. 单氨氧化酶
D. 甲基转移酶
E. 谷丙转氨酶

正确答案：A。谷胱甘肽（GSH）

解析：本题考查砷导致细胞凋亡的机制。三氧化二砷与细胞内抗氧化分子如谷胱甘肽（GSH）（A对BCDE错）结合后，可导致细胞清除氧自由基能力、抗氧化能力下降，使细胞内超氧化物相对增多，从而诱导细胞凋亡。